关于青少年情绪、情感的特点，以下说法不正确的是
A. 情绪敏感
B. 情绪反应强烈
C. 情绪心境化
D. 情感丰富
E. 情绪稳定

正确答案：E。情绪稳定

解析：青少年的情绪容易受外界的影响，不稳定，容易冲动，易从一个极端走向另一个极端（E错，为本题正确选项）。想象力丰富、思维活跃，情感丰富，容易理想化，可塑性大，易受外界的影响，情绪容易波动（ABCD正确）。